某小学组织学生接种乙肝疫苗，有学生因出现头痛、呕吐、四肢乏力因而送到医院就诊，首诊医师及时处置并报告医院有关部门，经医护人员解释、安抚后，39名学生未经治疗症状很快消失，5名学生仍感恶心，并伴有焦虑。医院组织专家会诊后排除了疫苗和其他躯体疾病所致。根据《疫苗流通与预防接种管理条例》，该事件所出现的情况属于
A. 药品不良反应
B. 群体性心因性反应
C. 预防接种异常反应
D. 医疗事故
E. 突发公共卫生事件

正确答案：B。群体性心因性反应

解析：小学组织接种疫苗后，部分学生因出现头痛、呕吐、四肢乏力等不适症状，其中39名学生经医护人员解释、安抚后症状很快消失，余下5名学生经医院组织专家会诊后亦排除了疫苗和其他躯体疾病所致，故该事件所出现的情况属于因心理因素发生的群体性心因性反应（B对），群体性心因性反应属于Ⅲ级突发公共卫生事件（E错）。药物不良反应（A错）是指在正常用法用量下出现的与药物目的无关的或意外的有害反应。预防接种异常反应（C错）是指疫苗接种过程中或接种后造成组织器官、功能损害，该例中专家已排除了疫苗所致。医疗事故（D错）是指医疗机构及其医务人员在医疗活动中，违反医疗卫生管理法律、行政法规、部门规章和诊疗护理规范、常规，过失造成患者人身损害的事故；该例未提及医务人员的违规操作。